女性，47岁，16缺失，15、17为健康活髓牙。行567金属烤瓷固定桥粘固后4天复诊，主诉咬合时疼痛。此时首先要检查的是
A. 基牙根尖状况
B. 基牙牙槽骨状况
C. 基牙牙龈状况
D. 修复体咬合接触
E. 固位体边缘密合度

正确答案：D。修复体咬合接触

解析：本题考查固定局部义齿修复后可能出现的问题及处理。患者女性，47岁，16缺失，15、17为健康活髓牙（基牙健康）。行567金属烤瓷固定桥粘固后4天复诊（短期内复诊），主诉咬合时疼痛。此时首先要检查的是修复体咬合接触（D对）。固定桥粘固后短期内出现咬合痛：多为早接触点引起的牙周创伤，经过调（牙合）处理后，疼痛会很快消失。若未及时调（牙合）疼痛加剧时，则需要在局麻下拆除固定桥，待痊愈后重做。基牙根尖状况（A错）、基牙牙槽骨状况（B错）、基牙牙龈状况（C错）可引起咬合不适或疼痛，但基牙在修复前都为健康活髓牙，在修复后的短期内不可能迅速出现根尖周炎、牙周炎或牙龈炎。固位体边缘密合度（E错）一般不会引起咬合痛，一般会影响基牙牙龈的健康情况。因此，首先应该检查的是咬合关系。